急惊风痰湿惊风证的用方为
A. 银翘散
B. 羚角钩藤汤
C. 琥珀抱龙丸
D. 玉枢丹合保和丸
E. 黄连解毒汤合白头翁汤

正确答案：D。玉枢丹合保和丸

解析：急惊风之痰湿惊风证是由于痰湿郁久化热酿毒，内陷心包，引动肝风所致，治疗时应消食导滞，涤痰开窍，首选玉枢丹合保和丸（D对）。银翘散（A错）其功用为心凉透表，清热解毒，适用于急惊风之风热动风证。羚角钩藤汤（B错）其功用为凉肝息风，增液舒筋，与紫雪丹合用，适用于急惊风之邪陷心肝证。琥珀抱龙丸（C错）其功用为镇惊安神，适用于急惊风之暴受惊恐证。黄连解毒汤合白头翁汤（E错）适用于急惊风之湿热疫毒证。